某女，43岁，入睡困难，且多梦易醒，心悸健忘，精疲食少，四肢倦怠，腹胀便溏，面色少华，舌质淡，苔薄白，脉细无力，中医诊断为不寐。中医辨证是
A. 心火炽盛
B. 肝气郁结
C. 心脾两虚
D. 肾阴亏虚
E. 心肾阳虚

正确答案：C。心脾两虚

解析：本题考查的是不寐的辨证论治。入睡困难，且多梦易醒，心悸健忘，精疲食少，四肢倦怠，腹胀便溏，面色少华，舌质淡，苔薄白，脉细无力，中医诊断为不寐。中医辨证是心脾两虚（C对）。不寐心脾两虚证：【症状】不易入睡，多梦易醒，心悸健忘，神疲食少，伴头晕目眩，四肢倦怠，腹胀便溏，面色少华。舌淡苔薄，脉细无力。肝气郁结（B错）为郁证的辨证。郁证肝气郁结证：【症状】精神抑郁，情绪不宁，胸部满闷，胁肋胀痛，痛无定处，胸闷嗳气，喜太息，不思饮食，大便不调，或秘或溏泄。舌苔薄或腻，脉弦。肾阴亏虚（D错）为消渴的辨证。消渴肾阴亏虚证：【症状】尿频量多，浊如膏脂，腰酸膝软，头晕耳鸣，多梦遗精，乏力，皮肤干燥。舌红少苔，脉细数。辨证为心火炽盛（A错）或心肾阳虚（E错）的疾病，2022年考试指南未明确说明。